可引起Q-T间期轻度延长的药品是
A. 铝碳酸镁咀嚼片
B. 多潘立酮片
C. 奥美拉唑肠溶胶囊
D. 乳果糖口服溶液
E. 巴氯芬片

正确答案：B。多潘立酮片

解析：本题考查药物的相互作用。可引起Q-T间期轻度延长的药品是多潘立酮片（B对）。多潘立酮又名吗丁啉，为多巴胺D₂受体阻断剂，具有较强的促胃运动和止吐作用，用于治疗因胃排空延缓、胃食管反流、食管炎引起的消化不良，功能性、器质性、感染性疾病以及放、化疗所引起的恶心和呕吐。多潘立酮为促胃肠动力的药物，有促进脑垂体泌乳素释放的作用，在胃肠道出血、机械性肠梗阻、胃肠穿孔、分泌催乳素的垂体肿瘤患者禁用。因其可引起Q-T间期延长，导致心律失常，因此不宜与酮康唑口服制剂、红霉素或其他可能延长Q-T间期的CYP3A4酶强抑制剂（如氟康唑、伏立康唑、克拉霉素、胺碘酮、泰利霉素等）联用。铝碳酸镁咀嚼片（A错）可用于胃食管反流病患者胸痛偶发。铝碳酸镁属于抗酸药，抗酸药复方制剂组分中通常含有Ca²⁺、Mg²⁺等，与四环素类同服，可形成难溶性的配位化合物（络合物）而不利于吸收，影响疗效。奥美拉唑肠溶胶囊（C错）既是CYP2C19的底物，又是CYP2C19强抑制剂，氯吡格雷为前药，体内经CYP2C19代谢发挥抗血小板作用，两者同服，会降低氯吡格雷的疗效，使得患者的血栓不良事件增加。乳果糖口服溶液（D错）在结肠中被消化道菌丛转化成低分子量有机酸，故乳酸血症患者服用乳果糖可加重酸中毒，因此乳果糖禁用于乳酸血症患者。乳果糖导肠pH下降，可能引起结肠pH依赖性药物（如5-氨基水杨酸）的失活。巴氯芬片（E错）能通过血-脑屏障，引起头晕、恶心等中枢神经系统不良反应。巴氯芬和降压药合用可使血压下降作用加强。